玉屏风散和补中益气汤均可用治
A. 脾肺气虚，自汗易感者
B. 脾胃气虚，食少脘胀者
C. 气血不足，心悸怔忡者
D. 脾阳不足，吐衄便血者
E. 肝肾不足，腰膝酸软者

正确答案：A。脾肺气虚，自汗易感者

解析：玉屏风散和补中益气汤均可用治脾肺气虚，自汗易感者，玉屏风散功用为益气固表止汗，主治表虚自汗，本证多由卫虚腠理不密，感受风邪所致。表虚失固，营阴不能内守，津液外泄，则常自汗。方中黄芪，内可大补脾肺之气，外可固表止汗，为君药。白术益气健脾，培土生金，协黄芪以益气固表实卫，为臣药。二药相合，使气旺表实，则汗不外泄，风邪不得侵袭。补中益气汤功用为补中益气，升阳举陷。主治气虚发热证。身热自汗，渴喜热饮，气短乏力，舌淡，脉虚大无力。本证多由饮食劳倦，损伤脾胃气虚，清阳下陷所致。气虚腠理不固，阴液外泄则自汗。方中重用黄芪为君，补中气，固表气。臣以人参大补元气；炙甘草补脾和中（A对）。